朊病毒主要可引起的疾病是
A. 狂犬病
B. 克雅病
C. 艾滋病
D. 莱姆病
E. 恙虫病

正确答案：B。克雅病

解析：朊病毒在人和动物中引起传染性海绵状脑病，为一种潜伏期长，中枢神经系统致死性慢性退化性疾病，主要包括人的进行性痴呆和震颤病（库鲁病，Kuru病）、克-雅病（CJD）及其变异性CJD（vCJD）、格-斯综合征（GSS）及致死性家族性失眠症（FFI）等，动物疾病如羊瘙痒病及牛海绵状脑病（BSE，即疯牛病）等。掌握“朊粒”知识点。